女，25岁。产后10天，下腹痛伴发热3天。查体：T39℃，P98/分，R26次/分。脓血性恶露，有恶臭。血常规：WBC13×10⁹/L，N0.88。最可能的判断结果是
A. 晚期产后出血
B. 产褥中暑
C. 急性膀胱炎
D. 正常产褥
E. 产褥感染

正确答案：E。产褥感染

解析：青年女性，产后10天（在6周内，仍处于产褥期内），出现发热（39℃）、下腹疼痛、脓血性恶露，有恶臭（发热、疼痛、异常恶露，为产褥感染三大主要症状），血常规：WBC13×10⁹/L（正常值4～10×10⁹/L，提示白细胞增多），N0.88（正常值50～70，中性粒细胞比例增加，说明存在感染），最可能判断为产褥感染（E对）。晚期产后出血（P229）（A错）是指24小时后，在产褥期内发生的子宫大量出血。产褥中暑（P224）（B错）是指产褥期因高温环境使体内余热不能及时散发，引起中枢性体温调节功能障碍的急性热病，表现为高热、水电解质紊乱、循环衰竭和神经系统功能损害等。急性膀胱炎（C错）表现为膀胱刺激联征，无脓血性恶露，有恶臭。正常产褥（P222）（D错）表现为产后体温多数在正常范围内，子宫复旧，产后宫缩痛，恶露有血腥味，但无臭味。